以下哪种牙位常见特纳牙
A. 乳前牙
B. 乳磨牙
C. 恒切牙
D. 前磨牙
E. 恒磨牙

正确答案：D。前磨牙

解析：本题考查釉质发育不全。特纳（Turner）牙往往是个别牙，以前磨牙（D对）居多。